关于概率抽样方法的误差大小，下列排列正确的是
A. 单纯随机抽样＜系统抽样＜分层抽样＜整群抽样
B. 单纯随机抽样＜分层抽样＜系统抽样＜整群抽样
C. 分层抽样＜系统抽样＜单纯随机抽样＜整群抽样
D. 单纯随机抽样＜分层抽样＜系统抽样＜整群抽样

正确答案：C。分层抽样＜系统抽样＜单纯随机抽样＜整群抽样

解析：本题考查概率抽样方法的误差大小。概率抽样方法的误差大小排列为：分层抽样＜系统抽样＜单纯随机抽样＜整群抽样（C对ABDE错）。